幽门螺杆菌结合部位在胃窦细胞，它可随胃窦细胞进入十二指肠引起炎症、削弱粘膜，使其易于遭受酸的损伤，由此支持幽门螺杆菌是十二指肠溃疡的发病原因，这一推理运用了因果判断标准中的
A. 关联的时间顺序
B. 关联的强度
C. 关联的可重复性
D. 关联的合理性

正确答案：D。关联的合理性

解析：本题考查病因及其发现和推断中的生物学合理性。支持幽门螺杆菌是十二指肠溃疡的发病原因，这一推理运用了因果判断标准中的关联的合理性（D对ABC错）。它表示病因假设与该疾病有关的事实、知识和理论相符合或一致的程度。